以上哪种疾病的主要病理变化为上皮增生，有过度正角化或过度不全角化或者混合角化
A. 扁平苔藓
B. 红斑
C. 白斑
D. 天疱疮
E. 黏膜下纤维化

正确答案：C。白斑

解析：本题考查口腔扁平苔藓与慢性盘状红斑狼疮。白斑（C对）的主要病理改变为上皮增生，有过度正角化或不全角化，或两者同时出现为混合角化。